小剂量的片剂、膜剂、胶囊剂等一般应作
A. 重量差异检查
B. 崩解时限检查
C. 含量均匀度检查
D. 溶出度测定
E. 不溶性微粒检查

正确答案：C。含量均匀度检查

解析：本题考查含量均匀度检查。小剂量的片剂、膜剂、胶囊剂等一般应作含量均匀度检查（C对）；重量差异（A错）指按规定称量方法测得片剂每片的重量与平均片重之间的差异程度；崩解时限（B错）是片剂、胶囊和滴丸制剂的重要控制指标；溶出度检查（D错）为难溶性药物的质量要求；不可溶性微粒检查（E错）为注射剂的质量要求。